关于药品分类管理的说法，正确的有
A. 根据药品品种、规格、适应症、剂量及给药途径的不同，对药品分为处方药和非处方药
B. 根据药品的安全性，非处方药分为甲、乙两类
C. 非处方药目录由国家食品监督管理部门遴选、审批、发布和调整工作
D. 处方药目录由卫生行政部门遴选调整
E. 各省可以根据当地经济水平、用药需求和用药习惯适当调整乙类非处方药目录

正确答案：A、B、C。根据药品品种、规格、适应症、剂量及给药途径的不同，对药品分为处方药和非处方药；根据药品的安全性，非处方药分为甲、乙两类；非处方药目录由国家食品监督管理部门遴选、审批、发布和调整工作

解析：本题考查处方药与非处方药分类管理。关于药品分类管理的说法，正确的有根据药品品种、规格、适应症、剂量及给药途径的不同，对药品分为处方药和非处方药（A对）；根据药品的安全性，非处方药分为甲、乙两类（B对）；非处方药目录由国家食品监督管理部门遴选、审批、发布和调整工作（C对）。《处方药与非处方药分类管理办法（试行）》第二条：根据药品品种、规格、适应症、剂量及给药途径不同，对药品分别按处方药与非处方药进行管理。处方药必须凭执业医师或执业助理医师处方才可调配、购买和使用；非处方药不需要凭执业医师或执业助理医师处方即可自行判断、购买和使用。第三条：国家药品监督管理局负责处方药与非处方药分类管理办法的制定。各级药品监督管理部门负责辖区内处方药与非处方药分类管理的组织实施和监督管理（DE错）。第四条：国家药品监督管理局负责非处方药目录的遴选、审批、发布和调整工作。第八条：根据药品的安全性，非处方药分为甲、乙两类。经营处方药、非处方药的批发企业和经营处方药、甲类非处方药的零售企业必须具有《药品经营企业许可证》。经省级药品监督管理部门或其授权的药品监督管理部门批准的其他商业企业可以零售乙类非处方药。